48岁，白带多，接触出血半年。妇科检查：宫颈糜烂状，阴道外观正常，子宫正常大小、双侧附件区无明显增厚。首选确诊检查是
A. 宫颈锥切术
B. 宫颈和宫颈管活检
C. 宫颈涂片检查
D. 阴道镜检
E. 宫颈荧光检查

正确答案：B。宫颈和宫颈管活检

解析：该患者为中老年女性，出现接触性出血半年（宫颈癌常表现为接触性阴道流血），妇检宫颈糜烂状，阴道外观正常，子宫正常大小，双侧附件区无明显增厚，高度怀疑子宫颈癌。为明确诊断首选宫颈和宫颈管活检（B对）。宫颈锥切术（P307）（A错）用于子宫颈细胞学检查多次阳性而子宫颈活检阴性者，或子宫颈活检为CINⅡ和CINⅢ需确诊者，或可疑微小浸润癌需了解病灶的浸润深度和宽度等情况。宫颈涂片检查（P303）（C错）主要用于CIN及早期子宫颈癌筛查的基本方法，也是诊断的必须步骤。阴道镜检查（P443）（D错）主要用于观察阴道和宫颈，对可疑部位行定位，结合活检方可确诊。宫颈荧光检查（E错）主要用于癌症的早期筛查，可通过分析被检组织发出的荧光色泽判断其是否癌变或癌前病变。